我国饮用水的卫生标准（GB5749-85）中规定
A. 每100ml饮水中细菌总数不超过10个
B. 每100ml饮水中细菌总数不超过100个
C. 每100ml饮水中细菌总数不超过1000个
D. 每1ml饮水中细菌总数不超过100个
E. 每500ml饮水中细菌总数不超过10个

正确答案：D。每1ml饮水中细菌总数不超过100个

解析：我国生活饮用水卫生标准（GB5749-2006）中规定每1ml饮水中细菌总数不超过100个。此题正确答案为D。